以下哪项不是年轻恒牙龋病的特点
A. 发病早
B. 耐酸性差易患龋
C. 龋坏进展快，易形成牙髓炎和根尖周炎
D. 受乳牙患龋状态的影响
E. 第一恒磨牙常出现肉眼可见的大面积龋坏

正确答案：E。第一恒磨牙常出现肉眼可见的大面积龋坏

解析：本题考查年轻恒牙龋。年轻恒牙龋病的特点：①发病早。第一恒磨牙（六龄牙）萌出早，龋齿发生早（A对），患龋率高。在混合牙列期，第一恒磨牙易被误认为乳磨牙而延误治疗；②耐酸性差易患龋（B对）。年轻恒牙牙体硬组织矿化程度比成熟恒牙釉质差，在牙齿新萌出的2年内易患龋；③龋坏进展快，易形成牙髓炎和根尖周炎（C对），年轻恒牙的髓腔大，髓角高，牙本质小管粗大，髓腔又近牙齿表面，所以龋齿进展速度快，加上年轻恒牙矿化程度差，龋患往往很快波及牙髓。④受患龋状态的影响（D对）。临床上常见因第二乳磨牙远中面龋未经过及时治疗，导致远中的第一恒磨牙的近中面脱矿和龋洞形成。乳牙龋多发对于刚萌出的年轻恒牙存在较大的患龋隐患。⑤第一恒磨牙常出现潜行性龋（隐匿性龋）（E错，为本题正确答案）。因为釉板结构的存在，致龋细菌可直接在牙体内部形成龋洞，而牙齿表面完好无损。